可引起致死性肺毒性和肝毒性的抗心律失常药物是
A. 普萘洛尔
B. 胺碘酮
C. 利多卡因
D. 奎尼丁
E. 维拉帕米

正确答案：B。胺碘酮

解析：本题考查胺碘酮。胺碘酮（B对）常见不良反应有肺毒性、肝毒性、甲状腺功能异常等。普萘洛尔（A错）不良反应有诱发支气管痉挛，致使心动过缓、房室传导阻滞等。利多卡因（C错）不良反应主要表现在中枢神经系统，如嗜睡、眩晕、头痛等。奎尼丁（D错）常见不良反应是胃肠道反应和中枢神经系统反应。维拉帕米（E错）常见不良反应为胃肠道反应和中枢神经症状。